执业药师管理职责分工中，由省级食品药品监管管理部门组织实施的是
A. 执业药师考前的培训
B. 执业药师资格考试考务工作
C. 执业药师继续教育
D. 执业药师执业注册许可

正确答案：D。执业药师执业注册许可

解析：本题考查的是执业药师注册要求。执业药师管理职责分工中，由省级食品药品监管管理部门组织实施的是执业药师执业注册许可（D对）。执业药师注册要求：我国执业药师实行注册制度，国家药品监督管理局负责执业药师注册的政策制定和组织实施，指导全国执业药师注册管理工作。各省、自治区、直辖市药品监督管理部门负责本行政区域内的执业药师注册管理工作。取得执业药师职业资格的药学专业技术人员，经执业单位考核同意，通过全国执业药师注册管理信息系统向所在地注册管理机构申请注册。经批准注册者，由执业药师注册管理机构核发国家药监局统一样式的《执业药师注册证》，方可从事相应的执业活动。未经注册者，不得以执业药师身份执业。执业药师注册有效期为五年。需要延续的，应当在有效期届满三十日前，向所在地注册管理机构提出延续注册申请。目前，执业药师职业资格考试工作由国家药品监督管理局与人力资源社会保障部共同负责，日常管理工作委托国家药品监督管理局执业药师资格认证中心负责，考务工作（B错）委托人力资源社会保障部人事考试中心负责。国家药品监督管理局高级研修学院（国家药品监督管理局安全应急演练中心）的主要职责为：①实施公务人员高级研修，承担监管政策理论研究及人才队伍发展战略研究。②承担职业化药品检查员教育培训工作。③承担药品监管系统教育培训研究、课题开发和培训教学实施。④组织开展执业药师考前培训（A错）、继续教育（C错）、师资培训及相关工作。⑤开展药品安全专业技术人员培训工作。⑥负责药品安全关键岗位从业人员（工种）技能鉴定相关工作。⑦拟定药品监管教育培训相关学科、课程和教材体系建设规划并组织实施。